地面水中三氮含量为：氨氮（﹢﹢）、亚硝酸盐氮（-）、硝酸盐氮（﹢﹢），则说明地面水
A. 新近受到污染，自净正在进行
B. 曾受到污染，但自净已经结束
C. 过去受到过污染，目前正在进行自净
D. 过去受到污染已经自净，最近又受到污染
E. 以上情况都不是

正确答案：D。过去受到污染已经自净，最近又受到污染

解析：本题考查地面水受污染情况。地面水中的三种氮含量分别为氨氮（﹢﹢）、亚硝酸盐氮（-）、硝酸盐氮（﹢﹢），其中氨氮和硝酸盐氮的含量都较高，而亚硝酸盐氮的含量较低，这表明地面水中有一定的污染物，但是污染物的含量并不是很高，而且污染物的含量正在逐渐减少，这表明地面水过去受到污染，但是已经自净，最近又受到污染（D对ABCE错）。